男，50岁，30年吸烟史。支气管镜活检可见鳞状上皮和支气管腺体。此种病理变化属于
A. 支气管黏膜化生
B. 支气管黏膜肥大
C. 支气管黏膜萎缩
D. 支气管鳞状细胞癌
E. 支气管腺癌

正确答案：A。支气管黏膜化生

解析：中年男性患者，既往有30年吸烟史，支气管镜活检不见正常的假复层纤毛柱状上皮，而见鳞状上皮被覆，此种病理变化应考虑为支气管黏膜（鳞状上皮）化生（A对）。